治疗原发性肝癌湿热瘀毒证，应首选
A. 逍遥散合桃红四物汤
B. 茵陈蒿汤合膈下逐瘀汤
C. 犀角地黄汤
D. 失笑散合丹参饮
E. 柴胡疏肝散

正确答案：B。茵陈蒿汤合膈下逐瘀汤

解析：茵陈蒿汤合膈下逐瘀汤（B对）可以清利湿热，化瘀解毒，用于治疗原发性肝癌湿热瘀毒证。逍遥散合桃红四物汤（A错）用于治疗气滞血瘀证。犀角地黄汤（C错）治疗热入血分证。失笑散合丹参饮（D错）治疗瘀血证。柴胡疏肝散（E错）治疗气滞血瘀证。